男性，26岁，轻度黄疸，肝肋下1.5cm,Hb70g/L,Coombs试验阳性，诊断应先考虑
A. 黄疸性肝炎
B. 早期肝硬化
C. 缺铁性贫血
D. 肝炎并贫血
E. 自身免疫性溶血性贫血

正确答案：E。自身免疫性溶血性贫血

解析：男性，26岁，轻度黄疸，肝肋下1.5cm，Hb70g/L（黄疸和贫血是自身免疫性溶血性贫血的特征），Coombs试验阳性（是检测血液中温反应性抗体的一种方法，也是诊断自身免疫性溶血性贫血的重要指标），考虑诊断为自身免疫性溶血性贫血（E对）。